决定体质的主要物质基础是
A. 脏腑经络
B. 精神状态
C. 精气血津液
D. 奇恒之腑
E. 神明之府

正确答案：C。精气血津液

解析：精气血津液是决定体质特征的重要物质基础，其中精的盈亏是体质差异的根本（C对）。人体以脏腑经络为中心，以精气血津液为物质基础，调节着体内外环境的平衡。故脏腑经络及精气血津液是体制形成的生理学基础。脏腑经络的盛衰偏颇决定体质的差异（A错）。脏腑的形态和功能特点是构成并决定体质差异的最根本因素。